环境质量评价的主要内容有
A. 污染源、污染程度和环境质量
B. 污染源、污染方式和环境效应
C. 污染源、环境质量和环境效应
D. 污染源、污染范围和环境质量
E. 污染源、环境效应和环境治理

正确答案：C。污染源、环境质量和环境效应